下列溶液中，宜用气相色谱电子捕获检测器测定残留量的是
A. 苯
B. 甲苯
C. 乙醇
D. 三氯甲烷
E. 乙酸乙酯

正确答案：D。三氯甲烷

解析：本题考查残留溶剂的测定。残留溶剂的测定通常使用火焰离子化检测器（FID），对含卤素元素的残留溶剂如三氯甲烷（D对）等，采用电子捕获检测器（ECD），易得到高的灵敏度。